面见青色，脉见弦象的是
A. 肝病
B. 心病
C. 脾病
D. 肺病
E. 肾病

正确答案：A。肝病

解析：肝主疏泄，调畅气机，以柔和为贵；若情志不遂，肝气郁结，疏泄失常，气郁不利致经脉拘束则见弦脉；弦脉在脏应肝，是脉气紧张的表现。肝在色为青，故面见青色，脉见弦象的是肝病（A对）。